属于第二级预防措施的是
A. 接种疫苗
B. 健康促进
C. 遗传咨询
D. 早期诊断
E. 病后恢复

正确答案：D。早期诊断